适于进餐时服用，可减少脂肪吸收率的药品是
A. 多潘立酮
B. 奥利司他
C. 甲氧氯普胺
D. 氢氧化铝
E. 鞣酸蛋白

正确答案：B。奥利司他

解析：本题考查减重药物。奥利司他（B对）为脂肪酶抑制剂，应进餐时服用，可使膳食脂肪吸收约减少33% ，未吸收的三酰甘油和胆固醇随大便排出，从而达到减重的目的。多潘立酮（A错）为胃肠动力药。甲氧氯普胺（C错）为止吐药。氢氧化铝（D错）为抗酸药。鞣酸蛋白（E错）为止泻药。